以下外国药典的缩写是日本药局方的是
A. JP
B. USP
C. BP
D. ChP
E. pH.Eur.

正确答案：A。JP

解析：本题考查药典。以下外国药典的缩写是日本药局方的是JP（A对）。日本药典的名称是《日本药局方》，英文名称是Japanese pHarmacopoeia，缩写为JP，由日本药局方编辑委员会编制。USP（B错）是《美国药典》的缩写。BP（C错）是《英国药典》的缩写。ChP（D错）为《中国药典》的缩写。Ph.Eur.（E错）是《欧洲药典》的缩写。